IU/ml）。最可能的诊断是
A. 痛风性关节炎
B. 风湿性关节炎
C. 类风湿关节炎
D. 骨关节炎
E. 半月板损伤

正确答案：D。骨关节炎

解析：患者老年男性（骨关节炎好发人群），上、下楼梯时双膝关节疼痛，查体：双手远端指间关节背侧可见Heberden结节（骨关节炎的特征性体征），双膝活动有摩擦感。实验室检查：ESR和RF均正常，综合患者的临床表现、查体和实验室检查，最可能的诊断是骨关节炎（D对）。痛风性关节炎（P861）（A错）主要表现为夜间或清晨突然起病，关节剧痛，呈撕裂样、刀割样或咬噬样，多于数天或2周自行缓解。风湿性关节炎（P805）（B错）呈游走性、多发性炎，局部可有红、肿、灼热、疼痛和压痛，关节疼痛很少持续一个月以上，通常在2周内消退。类风湿关节炎（P808）（C错）多发生于腕、掌指、近端指间关节，常伴有超过1小时的晨僵，类风湿因子RF多数呈阳性。半月板损伤（九版外科学P669）（E错）主要表现为关节间隙压痛、弹跳、膝关节屈曲挛缩与股内侧肌的萎缩，有关节交锁的现象。